卡托普利的作用原理是
A. 降低肾素活性
B. 抑制血管紧张素转换酶
C. 减少血管紧张素Ⅰ的生成
D. 抑制β-经化酶
E. 阻断血管紧张素受体

正确答案：B。抑制血管紧张素转换酶